阿司匹林含量测定的方法为
A. 用氢氧化钠滴定液滴定，用溴甲酚绿作指示剂
B. 用氢氧化钠滴定液滴定，用酚酞作指示剂
C. 用硫酸滴定液滴定，用甲基红作指示剂
D. 用高氯酸滴定液滴定，用结晶紫作指示剂
E. 用碘滴定液滴定，用淀粉作指示剂

正确答案：B。用氢氧化钠滴定液滴定，用酚酞作指示剂

解析：本题考查含量测定法。阿司匹林含量测定的方法为用氢氧化钠滴定液滴定，用酚酞作指示剂（C对）。方法:以中性乙醇(对酚酞指示液显中性)为溶剂溶解供试品，以酚酞为指示剂（酚酞变色范围为6.7～8.4），用氢氧化钠滴定液（0.1mol/L）滴定，每1ml氢氧化钠滴定液（0.1mol/L）相当于18.02mg的C₉H₈O₄。用溴甲酚绿作指示剂（A错），溴甲酚绿变色范围为3.8～5.4，生成物质无显色反应。用硫酸滴定液滴定，用甲基红作指示剂（C错）为酸碱滴定法，甲基红的变色范围为4.4～6.2。用高氯酸滴定液滴定，用结晶紫作指示剂（D错）为非水碱量法，主要用于测定有机弱碱及其氢卤酸盐、硫酸盐、磷酸盐等。用碘滴定液滴定，用淀粉作指示剂（E错）为碘量法，属于氧化还原滴定。